关于含特殊药品复方制剂购销管理的说法，错误的是
A. 具有蛋白同化制剂、肽类激素定点批发资质的药品经营企业，方可从事含麻黄碱类复方制剂的批发业务
B. 药品零售企业不得开架销售含麻黄碱类复方制剂
C. 具有蛋白同化制剂肽类激素定点批发资质的药品经营企业，方可从事复方甘草片、复方地芬诺酯片的批发业务
D. 药品零售企业不得开架销售复方甘草片、复方地芬诺酯片

正确答案：C。具有蛋白同化制剂肽类激素定点批发资质的药品经营企业，方可从事复方甘草片、复方地芬诺酯片的批发业务

解析：本题考查含特殊药品复方制剂的经营管理。具有《药品经营许可证》的药品生产企业和药品批发企业均可从事复方甘草片、复方地芬诺酯片的批发业务（C错，为本题正确答案）。复方甘草片与复方地芬诺酯片为含特殊药品复方制剂。含特殊药品复方制剂的经营管理：具有《药品经营许可证》的企业均可经营含特殊药品复方制剂。药品上市许可持有人、药品生产企业和药品批发企业可以将含特殊药品复方制剂销售给药品批发企业、药品零售企业和医疗机构（另有规定的除外）。药品零售企业销售复方甘草片、复方地芬诺酯片应设置专柜由专人管理、专册登记（D对），上述药品登记内容包括：药品名称、规格、销售数量、生产企业、生产批号。药品零售企业销售含特殊药品复方制剂时，如发现超过正常医疗需求，大量、多次购买上述药品的，应当立即向当地药品监督管理部门报告。具有蛋白同化制剂、肽类激素定点批发资质的药品经营企业，方可从事含麻黄碱类复方制剂的批发业务（A对）。药品零售企业不得开架销售含麻黄碱类复方制剂（B对），应当设置专柜由专人管理、专册登记，登记内容包括药品名称、规格、销售数量、生产企业、生产批号、购买人姓名、身份证号码。